大量腹腔积液呼吸形式是
A. 叹息式呼吸
B. 长吸式呼吸
C. 胸式呼吸
D. 腹式呼吸
E. 混合式呼吸

正确答案：C。胸式呼吸

解析：正常男性和儿童的呼吸为腹式呼吸（D错）；女性的呼吸则以肋间肌的运动为主，形成胸式呼吸。实际上该两种呼吸运动均不同程度地同时存在（E错）。某些疾病可使呼吸运动发生改变，肺或胸膜疾病如肺炎、重症肺结核和胸膜炎等，或胸壁疾病如肋间神经痛、肋骨骨折等，均可使胸式呼吸减弱而腹式呼吸增强。腹膜炎、大量腹水，肝脾极度肿大，腹腔内巨大肿瘤及妊娠晚期时，膈肌向下运动受限，则腹式呼吸减弱，而代之以胸式呼吸。当腹腔内有大量积液称腹水，大量腹腔积液呼吸形式是胸式呼吸（C对）。叹息式呼吸（A错）可见于神经精神性呼吸困难（八版诊断学P24）。长吸式呼吸（B错）可以出现在很多情况下，机制不清，多提示脑干损伤。